卡环的颊舌臂之间应有
A. 吸附力
B. 附着力
C. 协调作用
D. 交互对抗作用
E. 交叉作用

正确答案：D。交互对抗作用

解析：颊舌臂要有交互对抗的力，颊舌侧力量不平衡，也可使基托压迫黏膜造成疼痛。掌握“局部义齿固位体”知识点。